某患者，右上6缺失，行双端固定桥修复，固定桥试戴时桥体黏膜发白，最可能的原因是
A. 就位道不一致
B. 邻面接触点过紧
C. 有早接触
D. 制作的桥体龈端过长
E. 固位体边缘过长

正确答案：D。制作的桥体龈端过长

解析：固定桥试戴时桥体黏膜发白为制作的桥体龈端过长压迫所致。掌握“固定桥修复后出现的问题及处理”知识点。